以下为自身免疫性疾病的是
A. 急性化脓性腮腺炎
B. 慢性复发性腮腺炎
C. 流行性腮腺炎
D. 舍格伦综合征
E. 腮腺放线菌病

正确答案：D。舍格伦综合征

解析：本题考查自身免疫性疾病。舍格伦综合征（D对）是一种自身免疫性疾病，确切病因及发病机制尚不十分明确。急性化脓性腮腺炎（A错）是唾液腺的化脓性炎症。慢性复发性腮腺炎（B错）主要表现为腮腺反复肿胀，属于唾液腺炎症的一种。流行性腮腺炎（C错）是由于副黏液病毒感染引起的炎症性疾病。腮腺放线菌病（E错）是一类慢性化脓性肉芽肿性疾病。